若诊断为逆行性牙髓炎，检查最重要的是
A. 牙龈出血
B. 龈下牙石
C. 牙周溢脓
D. 深牙周袋
E. 深的龋洞

正确答案：D。深牙周袋

解析：逆行性牙髓炎诊断和鉴别诊断：①牙周病史，有急、慢性牙髓炎的症状。②无严重的牙体疾病，有接近或到达根尖深牙周袋。③温度测验明显异常。④X线片患牙牙槽骨吸收。掌握“残髓炎及逆行性牙髓炎”知识点。